采用平阳霉素治疗，效果最佳的是
A. 囊肿型淋巴管瘤
B. 海绵型淋巴管瘤
C. 毛细管型淋巴管瘤
D. 毛细管型血管瘤
E. 蔓状血管瘤

正确答案：A。囊肿型淋巴管瘤

解析：本题考查采用平阳霉素治疗的疾病。平阳霉素能使内皮细胞变性、萎缩、退化，致使血管瘤或淋巴管瘤消退。临床上采用平阳霉素治疗血管瘤和脉管畸形的主要适应症为静脉畸形（即海绵状血管瘤）和大囊型淋巴管畸形（囊肿型淋巴管瘤）（A对）。淋巴管畸形主要治疗方法为硬化剂注射，配合手术治疗（BC错）。毛细管型血管瘤可口服普萘洛尔（D错）。蔓状血管瘤通常采用经导管动脉栓塞技术（E错）。